用于治疗人破伤风的抗毒素血清对人是
A. 抗原
B. 半抗原
C. 抗体
D. 不完全抗体
E. 抗原抗体复合物

正确答案：A。抗原

解析：用于治疗人破伤风的抗毒素血清对人是抗原，抗毒素是抗体。抗毒素：对毒素具有中和作用的特异性抗体。抗毒素血清：含有针对某种毒素的抗体的血清。掌握“抗原基本概念、分类、超抗原及佐剂”知识点。